下列对健康管理与健康治理的联系与区别描述不正确的是
A. 管理对象、内容和范畴完全不同
B. 二者都是解决公众健康问题的重要手段
C. 二者通过横纵联合形成健康管理网络
D. 二者行动主体不同
E. 二者管理手段不同

正确答案：A。管理对象、内容和范畴完全不同

解析：本题考查健康管理与健康治理的联系与区别。健康管理与健康治理的联系与区别为：①管理对象、内容和范畴虽相互重叠但各有侧重（A错，为本题正确答案）；②二者都是解决公众健康问题的重要手段（B对）；③二者通过横纵联合形成健康管理网络（C对）；④二者行动主体不同（D对）；④二者管理手段不同（E对）。